垂直于牙面的薄层结构，在磨片中呈裂隙状结构
A. 无釉柱釉质
B. 釉板
C. 釉索
D. 釉龛
E. 釉结

正确答案：B。釉板

解析：本题考查釉板。垂直于牙面的薄层结构，在磨片中呈裂隙状结构，是釉板（B对）。无釉柱釉质位于近釉质牙本质界和多数乳牙及恒牙表层（A错）。釉索（C错）、釉龛（D错）、釉结（E错）为成釉器在牙齿发育期间存在的结构，无法在牙齿磨片中观察到。